激活真核基因组织特异性转录所必需的是
A. 操纵子
B. 启动子
C. 增强子
D. 沉默子
E. 衰减子

正确答案：C。增强子